患者，男，35岁。进食时左侧下颌下腺区肿胀、疼痛，停止进食数小时后，疼痛亦随之消退。检查见左侧导管口黏膜红肿，导管呈条索状，挤压腺体可见少许脓性分泌物自导管口溢出。进行唾液腺造影的禁忌证是
A. 肿瘤
B. 慢性炎症
C. 腺瘘
D. 口干
E. 急性炎症期间

正确答案：E。急性炎症期间

解析：唾液腺造影术禁忌证：①对碘过敏者；②唾液腺急性炎症期间；③唾液腺导管阳性结石，以避免注射造影剂时将结石向后推移。掌握“涎石病及下颌下腺炎”知识点。